女性患者，25岁，产后一个月，发现右乳外上象限处有一直径4cm大小的肿块，疼痛2天，乳房局部微红，伴恶寒发热，胸闷不舒，舌苔薄黄，脉弦数。应诊断为
A. 乳癖
B. 乳痈
C. 乳岩
D. 乳疠
E. 乳痨

正确答案：B。乳痈

解析：乳痈是发生在乳房部的最常见的急性化脓性疾病，临床特点是乳房结块，红肿热痛，溃后脓出稠厚，伴恶寒发热等全身症状。好发于产后1个月以内的哺乳妇女（B对）。乳癖是乳腺组织的既非炎症也非肿瘤的良性增生性疾病，乳痛和肿块与月经周期及情志变化密切相关，相当于西医学的乳腺增生病（A错）。乳岩是指发生在乳房部的恶性肿瘤，其临床特点是乳房肿块质地坚硬，凹凸不平，边界不清，推之不移，按之不痛，或乳头溢血，晚期可见溃烂凸如泛莲或菜花（C错）。乳疬是指男女儿童或中老年男性在乳晕部出现的疼痛性结块（D错）。乳痨是发生在乳房部的慢性化脓性疾病，因其病变后期常有虚痨表现（E错）。